粉末显微特征中有不规则分枝状石细胞和油细胞的药材是
A. 厚朴
B. 桑白皮
C. 白鲜皮
D. 香加皮
E. 地骨皮

正确答案：A。厚朴

解析：本题考查的是厚朴的显微鉴别。粉末显微特征中有不规则分枝状石细胞和油细胞的药材是厚朴（A对）。厚朴【显微鉴别】粉末厚朴、姜厚朴：石细胞类方形、椭圆形或不规则分枝状，直径11～65㎛，壁厚，有的可见层纹。油细胞椭圆形或类圆形，含黄棕色油状物。纤维甚多，壁甚厚，有的呈波浪形或一边呈锯齿状，木化，孔沟不明显。桑白皮（B错）【显微鉴别】粉末：淡灰黄色。纤维颇多，多已断碎，直径13～26㎛，壁厚，非木化至微木化。草酸钙方晶直径11～32㎛。淀粉粒众多，单粒或复粒；单粒多呈类圆形，直径4～16㎛，大粒可见脐点，呈点状或裂缝状；复粒由2～8分粒组成。石细胞类圆形、类方形、椭圆形或不规则形，直径22～52㎛，壁极厚或较厚，纹孔及孔沟明显，胞腔内有的含方晶。白鲜皮（C错）【显微鉴别】根皮横切面皮层和韧皮部均有单个散在纤维，薄壁细胞中含有多数草酸钙簇晶。香加皮（D错）【显微鉴别】粉末：淡棕色。石细胞长方形或类多角形，直径24～70㎛，壁厚，孔沟明显。草酸钙结晶呈方形、多面形、锥形或簇状，直径9～20㎛。乳汁管碎片含无色油滴状颗粒。木栓细胞棕黄色，多角形。淀粉粒甚多，单粒类圆形或长圆形，直径3～11㎛，脐点点状；复粒由2～6分粒组成。地骨皮（E错）【显微鉴别】枸杞根皮粉末：米黄色。草酸钙砂晶随处可见，结晶极细微，略呈箭头形，有的薄壁细胞充满砂晶。纤维多散在，长110～230㎛，木化或微木化，可见稀疏斜纹孔，腔内有时含黄棕色物。木栓细胞表面观呈多角形，垂周壁平直或微波状，有的微木化，胞腔中含黄色物。